牙冠延长术术后修复时机宜为
A. 术后即刻
B. 手术拆线后
C. 术后5天
D. 术后2周
E. 术后6周

正确答案：E。术后6周

解析：本题考查牙冠延长术。牙冠延长术术后修复时机宜为术后6周（E对）。牙冠延长术后1～2周戴临时冠（D错），6周开始永久修复。若过早进行（ABC错）永久修复，会干扰组织的正常愈合，愈合后还会造成修复体边缘暴露。